药物过敏性口炎多属于
A. Ⅰ型超敏反应
B. Ⅱ型超敏反应
C. Ⅲ型超敏反应
D. Ⅳ型超敏反应
E. Ⅴ型超敏反应

正确答案：A。Ⅰ型超敏反应

解析：药物过敏性口炎多属于Ⅰ型超敏反应。掌握“常见口腔过敏反应性疾病”知识点。